可摘局部义齿不稳定的表现不包括以下哪一项
A. 咀嚼效率低
B. 义齿摆动
C. 游离端基托翘起
D. 义齿旋转
E. 义齿下沉

正确答案：A。咀嚼效率低

解析：可摘局部义齿固位不稳定现象有：①翘起；②摆动；③旋转；④下沉。掌握“局部义齿的设计”知识点。